下8冠周炎常累及的是
A. 眶下间隙
B. 颞下间隙
C. 咽旁间隙
D. 颊间隙
E. 咬肌间隙

正确答案：E。咬肌间隙

解析：本题考查间隙感染。下8冠周炎常累及的是咬肌间隙（E对）。胶肌间隙感染主要来自下颌智齿冠周炎，下颌磨牙的根尖周炎、牙槽脓肿，亦可因相邻间隙如颞下间隙感染的扩散，偶有因化脓性腮腺炎波及者。眶下间隙（A错）感染多来自上颌尖牙、第一前磨牙和上颌切牙的根尖化脓性炎症和牙槽脓肿；此外，可因上颌骨骨髓炎的脓液穿破骨膜，或上唇底部与鼻侧的化脓性炎症扩散至眶下间隙引起。颞下间隙（B错）感染可从相邻间隙，如翼下颌间隙等感染扩散而来；也可因上颌结节、卵圆孔、圆孔阻滞麻醉时带入感染；或由上颌磨牙的根尖周感染或拔牙后感染引起。咽旁间隙（C错）感染多为牙源性，特别是下颌智齿冠周炎，腺源性如腭扁桃体炎以及相邻间隙感染的扩散。偶而继发于腮腺炎、耳源性炎症和颈深上淋巴结炎。颊间隙（D错）感染常来自上、下颌磨牙的根尖周脓肿或牙槽脓肿穿破骨膜，侵入颊间隙；也可因颊部皮肤损伤、黏膜溃疡继发感染或颊、颌上淋巴结的炎症扩散所致。